五味子的功效是
A. 生津安蛔
B. 敛肺滋肾
C. 温中止痛
D. 收敛止血
E. 涩肠温中

正确答案：B。敛肺滋肾

解析：本题考查的是五味子的功效。五味子的功效是敛肺滋肾（B对）。五味子：【功效】收敛固涩，益气生津，滋肾宁心。乌梅：【功效】敛肺，涩肠，生津，安蛔（A错），止血。花椒：【功效】温中止痛（C错），杀虫止痒。海螵蛸：【功效】收敛止血（D错），固精止带，制酸止痛，收湿敛疮。肉豆蔻：【功效】涩肠止泻，温中（E错）行气。